支气管哮喘可见的临床症状有
A. 胸闷、咳嗽、哮鸣音
B. 患者呈端坐呼吸
C. 白色泡沫痰，甚至发绀
D. 吸气延长，心搏徐缓
E. 心率加快，胸腹反常运动

正确答案：A、B、C、E。胸闷、咳嗽、哮鸣音；患者呈端坐呼吸；白色泡沫痰，甚至发绀；心率加快，胸腹反常运动

解析：本题考查支气管哮喘的临床症状。支气管哮喘简称哮喘，是在支气管高反应状态下，由于变应原或其他因素引起的可逆性的气道阻塞性疾病。临床表现为发作性伴有哮鸣音的呼气性呼吸困难(吸气短而促)或发作性胸闷和咳嗽（A对），严重者干咳或咳大量白色泡沫痰，甚至发绀等（C对），可自行或经治疗后缓解。体检可知胸部呈过度充气状态。严重哮喘患者可被迫采取坐位或呈端坐呼吸（B对），心率加快、奇脉、胸腹反常运动（E对）。吸气缩短，心率加快，心搏加快（D错）。